关于孕期保健，以下哪项正确
A. 第一次产前检查时间应在妊娠12～16周
B. 初诊应行全身检查、产科检查和必要的辅助检查
C. 应每个月进行一次产前检查
D. 产前检查应包括绒毛活检、B超、羊水穿刺等
E. B超是了解胎儿宫内安危的主要方法

正确答案：B。初诊应行全身检查、产科检查和必要的辅助检查

解析：本题考查孕期保健的相关内容。孕期初诊应行全身检查、产科检查和必要的辅助检查（B对ACDE错），孕期至少应进行5次检查，孕早期至少进行1次，孕中期至少2次，孕晚期至少2次（其中至少1次在36周后进行），发现异常应增加检查次数。